初孕妇，25岁。妊娠31周。从妊娠29周起反复3次阴道流血，量少，无腹痛。再次阴道流血同月经量。查体：P88次/分，BP110/70mmHg。子宫软，无宫缩，枕左前位，胎头高浮，胎心率144次/分。首先考虑的诊断是
A. 低置性前置胎盘
B. 中央性前置胎盘
C. 边缘性前置胎盘
D. 部分性前置胎盘
E. 前置血管破裂

正确答案：B。中央性前置胎盘

解析：青年孕妇，从妊娠29周（完全性前置胎盘初次出血时间多在妊娠28周左右，称为“警戒性出血”）起反复3次阴道流血，量少，无腹痛，子宫软，无宫缩，胎头高浮，胎心率144次/分（正常值在110～160bpm），首先考虑为中央性前置胎盘（完全性前置胎盘）（B对AE错）。边缘性前置胎盘（C错）出血多发生在妊娠晚期或临产后，出血量较少。部分性前置胎盘（D错）的初次出血时间、出血量及反复出血次数，介于两者之间。前置血管破裂（E错）是一种十分少见的产科疾病，其表现是妊娠中、晚期无痛性的阴道出血，阴道流血，伴胎心率变化，不规则，甚至消失。